创可贴的选购和使用注意事项中不包括
A. 成品包装应有“无菌”字样
B. 要有使用说明书
C. 要有环氧乙烷残留量标识
D. 切忌用手接触中间复合垫
E. 应有“包装破损禁用”标识

正确答案：C。要有环氧乙烷残留量标识